治疗皮肤浅表性癣菌病首选
A. 伏立康唑
B. 氟胞嘧啶
C. 氟康唑
D. 灰黄霉素
E. 特比萘芬

正确答案：E。特比萘芬

解析：本题考查特比萘芬。治疗皮肤浅表性癣菌病首选特比萘芬（E对）。特比萘芬对各种浅部真菌如毛癣菌属、小孢子菌属、表皮癣菌属均有明显的抗菌活性。伏立康唑（A错）属于三唑类抗菌药，是治疗侵袭性曲霉菌病的首选用药。氟胞嘧啶（B错）可与两性霉素B合用于深部真菌感染。氟康唑（C错）属于三唑类抗菌药，是治疗侵袭性念珠菌病的首选用药，适用于近期未用过唑类抗真菌药且临床情况稳定的念珠菌感染。灰黄霉素（D错）可抑制皮肤癣菌，口服用于抗表浅部真菌感染。